关于风疹的叙述中，不正确的是
A. 目前无特效的抗病毒治疗
B. 风疹疫苗对孕妇及胎儿具有保护作用
C. 风疹疫苗不但预防效果好，而且安全性很好
D. 成人感染风疹多不需要治疗
E. 早期治疗可以减少风疹对胎儿的损害

正确答案：E。早期治疗可以减少风疹对胎儿的损害